机体抗外毒素的免疫主要依靠
A. 激活的巨噬细胞分泌的蛋白酶类
B. IgG、IgM 抗体
C. 辅助T细胞
D. 靶细胞表面毒素受体被修饰
E. 细胞毒性T细胞

正确答案：B。IgG、IgM 抗体